属于甲类传染病的是
A. 传染性非典型肺炎
B. 麻疹
C. 霍乱
D. 艾滋病
E. 肺结核

正确答案：C。霍乱